能止咳平喘，润肠通便，且无毒性的药物是
A. 葶苈子
B. 杏仁
C. 白芥子
D. 黄药子
E. 苏子

正确答案：E。苏子

解析：该题考查紫苏子的药性及功效。紫苏子味辛，性温。无毒，归肺、大肠经，其功效为降气化痰，止咳平喘，润肠通便（E对）。